患儿，女，14岁。因出现尿频、尿急、尿痛症状2天就诊，诊断为急性膀胱炎，患儿既往有癫痫病史，宜选用的治疗药物是
A. 呋喃妥因
B. 青霉素G
C. 阿奇霉素
D. 环丙沙星
E. 克林霉素

正确答案：A。呋喃妥因

解析：本题考查呋喃妥因。宜选用的治疗药物是呋喃妥因（A对）。呋喃妥因是合成抗菌药，抗菌谱较广，临床上用于对其敏感的大肠埃希菌、肠球菌属、葡萄球菌属以及克雷伯菌属、肠杆菌属等细菌所致的急性单纯性下尿路感染，也可用于尿路感染的预防。青霉素G（B错）适用于溶血性链球菌、肺炎链球菌、对青霉素敏感（不产青霉素酶）金葡菌等革兰阳性球菌所致的感染以及破伤风、气性坏疽、流行性脑脊髓膜炎、鼠咬热、梅毒、淋病。阿奇霉素（C错）用于治疗化脓性链球菌引起的急性咽炎、急性扁桃体炎，敏感细菌引起的鼻窦炎、中耳炎、急性支气管炎、慢性支气管炎急性发作，肺炎链球菌、流感嗜血杆菌以及肺炎支原体所致的肺炎等。环丙沙星（D错）用于敏感菌感染所致的泌尿生殖系统感染、呼吸道感染、胃肠道感染、伤寒、骨和关节感染、皮肤软组织感染、败血症等全身感染。克林霉素（E错）用于链球菌属、葡萄球菌属及厌氧菌（包括脆弱拟杆菌、产气荚膜杆菌、放线菌等）所致的中、重度感染，如吸入性肺炎、脓胸、肺脓肿、骨髓炎、腹腔感染、盆腔感染及败血症等。